造成传染病年龄分布差异的最主要原因是
A. 体质差异
B. 免疫水平差异
C. 暴露机会不同
D. 疾病潜伏期的长短
E. 疾病表现的差异

正确答案：B。免疫水平差异

解析：本题考查传染病年龄分布差异的最主要原因。造成传染病年龄分布差异的最主要原因是：免疫水平差异（B对ACDE错）。